骨折线从梨状孔下部，经牙槽突底，至上颌结节至翼突为
A. LeFortⅠ型
B. LeFortⅡ型
C. LeFortⅢ型
D. 颅前窝骨折
E. 颅中窝骨折

正确答案：A。LeFortⅠ型

解析：本题考查上颌骨骨折。骨折线从梨状孔下部，经牙槽突底，至上颌结节至翼突为LeFortⅠ型（A对）。LeFortⅠ型：骨折线从梨状孔下部，经牙槽突基底部，向后至上颌结节呈水平状延伸至翼突。